化妆品的安全评价主要是针对
A. 特殊化妆品
B. 进口的化妆品
C. 化妆品的原料和成品
D. 使用后出现对人体可疑损害的化妆品
E. 市面上已在售的化妆品

正确答案：A。特殊化妆品

解析：本题考查化妆品的安全评价主要针对的化妆品。化妆品的安全评价主要是针对特殊化妆品（A对BCDE错）。特殊用途化妆品指用于育发、染发、烫发、脱毛、美乳、健美、除臭、祛斑和防晒的化妆品。这类化妆品为获得某种特殊功能，常需加入某些活性物质以便弥补体表局部缺陷而达到美化的目的。因此需要对其进行安全评价。